能滋阴润燥的药是
A. 知母
B. 芦根
C. 竹叶
D. 青葙子
E. 天花粉

正确答案：A。知母

解析：本题考查的是知母的功效。能滋阴润燥的药是知母（A对）。知母：【功效】清热泻火，滋阴润燥。芦根（B错）：【功效】清热生津，除烦止呕，利尿。竹叶（C错）：【功效】清热除烦，生津，利尿。青葙子（D错）：【功效】清肝泻火，明目退翳。天花粉（E错）：【功效】清热生津，清肺润燥，消肿排脓。